疑为苯丙酮尿症的儿童初筛应做
A. Guthri细菌生长抑制试验
B. 血清苯丙氨酸浓度测定
C. 尿三氯化铁试验
D. 尿甲苯胺蓝试验
E. 苯丙氨酸耐量试验

正确答案：C。尿三氯化铁试验

解析：苯丙酮尿症新生儿筛查多采用Guthrie细菌生长抑制试验（A错）以测定血液中苯丙氨酸（Phe）浓度。血清苯丙氨酸浓度测定主要用于筛查试验阳性患者的确诊（B错）。尿三氯化铁试验适用于较大儿童的筛查（C对）。尿甲苯胺蓝试验主要用于检查粘多糖增多症（P162）（D错）。苯丙氨酸耐量试验主要用于确诊而不是筛查：口服苯丙氨酸100mg/kg，1-4小时后查血苯丙氨酸升高，酪氨酸降低即可确诊（E错）。